女，31岁。产后5个月，哺乳期，阴道不规则流血半月余，胸闷咳嗽10天。妇科检查：宫颈前唇有一个2cm×1cm×1cm的紫蓝色结节，子宫如50天妊娠大小，质软，无压痛。双侧附件区各触及囊性包块，均约6cm×5cm×5cm大小，表面光滑。胸X线片示双肺下部多发棉絮状阴影。最可能的诊断是
A. 侵蚀性葡萄胎
B. 胎盘残留
C. 肺癌
D. 绒癌
E. 卵巢肿瘤

正确答案：D。绒癌

解析：女性患者，无葡萄胎妊娠病史，存在阴道不规则流血，胸闷咳嗽（肺转移表现）。妇科检查：宫颈前唇有一个紫蓝色结节（病灶侵及子宫浆膜层）。胸X线片示双肺下部多发棉絮状阴影（肺转移）。综合患者的症状、体征和辅助检查，最可能的诊断是绒癌（D对）。侵蚀性葡萄胎（A错）全部继发于葡萄胎妊娠。胎盘残留（B错）无紫蓝色结节及肺转移表现。肺癌（C错）、卵巢肿瘤（E错）无紫蓝色结节表现。